急性化脓性腮腺炎的病原菌主要是
A. 链球菌
B. 肺炎双球菌
C. 文森螺旋体
D. 金黄色葡萄球菌
E. 梭状杆菌

正确答案：D。金黄色葡萄球菌

解析：本题考查急性化脓性腮腺炎的病原菌。急性化脓性腮腺炎是指腮腺的急性化脓性炎症，以前常见于腹部大手术后，现多是慢性腮腺炎基础上的急性发作或系邻近组织急性炎症的扩散。其病原菌是是葡萄球菌，主要是金黄色葡萄球菌（D对），少数是链球菌（A错），而肺炎双球菌（B错）、文森螺旋体（C错）少见。螺旋杆菌和梭状杆菌（E错）常见于急性坏死性溃疡性龈炎。